先天性甲状腺功能减低症的治疗中，错误的是
A. 需甲状腺素终生治疗
B. 临床症状改善，T₄、TSH正常，此时甲状腺素剂量可作为维持量
C. 甲状腺素治疗维持到青春期即可停药
D. 甲状腺素自小剂量开始逐渐增加剂量
E. 出生后1～2个月开始治疗，可不遗留神经系统损害

正确答案：C。甲状腺素治疗维持到青春期即可停药